出现“猿手＂，是何神经损伤所致
A. 肌皮神经
B. 尺神经和桡神经
C. 桡神经
D. 正中神经和尺神经
E. 无

正确答案：D。正中神经和尺神经

解析：肱骨骨折和肩关节损伤时 可合并肌皮神经（A错）的损伤，此时表现为屈肘无力以及前臂外侧部皮肤感觉的减弱。正中神经损伤可出现腕管综合征，表现为鱼际肌萎缩，手掌变平呈＂猿掌＂，尺神经损伤导致掌指关节过伸，二者合并损伤导致出现“猿手”（D对）。在臂中段的后方，桡神经 紧贴肱骨的桡神经沟走行，因此肱骨中段 或中、下 1/3 交界处骨折容易合并啊、桡神经 的损伤，导致前臂伸肌群的瘫痪，表现为抬 前臂时呈‘垂腕’状, 同时第 1 、2 掌骨间背面皮肤感觉障碍明显（CB错）。